内脏痛的主要特点是
A. 刺痛
B. 快痛
C. 定位不精确
D. 必有牵涉痛
E. 对牵拉不敏感

正确答案：C。定位不精确

解析：内脏痛常由机械牵拉、痉挛、缺血和炎症等刺激所致。内脏痛的特点：①定位不精确（C对），这是内脏痛最主要的特点，因为痛觉感受器在内脏的分布比在躯体稀疏的多；②发生缓慢，持续时间较长，即主要表现为慢痛（B错），常呈渐进性增强，但有时也迅速转为剧烈痛；③中空内脏器官（如胃、肠、胆囊和胆管等）璧上的感受器对扩张性刺激和牵拉性刺激十分敏感（E错）；④特别能引起不愉快的情绪活动。牵涉痛（D错）是指由某些内脏疾病引起的远隔体表部位发生疼痛或痛觉过敏的现象，内脏痛不一定都会引起牵涉痛。